硝酸甘油治疗心绞痛的药理作用有
A. 升高血压
B. 减慢心率
C. 心肌收缩力增加
D. 开放侧支血管
E. 抑制NO释放

正确答案：D。开放侧支血管